以下药物中杂质的检查方法是，注射用青霉素钠中的青霉素聚合物
A. 紫外分光光度法
B. 热重分析法
C. 薄层色谱法
D. 分子排阻色谱法
E. 气相色谱法

正确答案：D。分子排阻色谱法